正常生理情况下，牙骨质比牙槽骨具有更强的
A. 吸收能力
B. 改建能力
C. 重塑能力
D. 抗吸收能力
E. 抗骨折能力

正确答案：D。抗吸收能力

解析：正常生理情况下，牙骨质不像骨组织可以不断的改建和重塑，而是较固有牙槽骨具有更强的抗吸收能力。掌握“牙骨质”知识点。